肾锥体属于
A. 肾皮质
B. 肾小盏
C. 肾大盏
D. 肾髓质
E. 肾窦

正确答案：D。肾髓质

解析：15~20个呈圆锥形的肾锥体（D对）构成肾髓质。